患者，女，17岁，昨晚进食火锅后出现呕吐酸腐，脘腹胀满，嗳气厌食，大便溏，舌苔厚腻，脉滑实，治疗应首选的方剂是
A. 藿香正气散
B. 理中丸
C. 竹茹汤
D. 保和丸
E. 平胃散

正确答案：D。保和丸

解析：根据患者“进食火锅后出现呕吐”，辨为“呕吐”,根据“呕吐酸腐，脘腹胀满，嗳气厌食，大便溏，舌苔厚腻，脉滑实”，辨为“饮食停滞证”。患者积食内停，中焦塞滞，胃气上逆，治宜消食化滞，和胃降逆，方选保和丸加减（D对）。